关于地西泮的叙述，哪项错误
A. 肌内注射吸收慢而不规则
B. 口服治疗量对呼吸和循环影响小
C. 较大剂量易引起全身麻醉
D. 可用于治疗癫痫持续状态
E. 其代谢产物也有生物活性

正确答案：C。较大剂量易引起全身麻醉